某患者因近3日腹泻腹痛前来就诊。自述有里急后重感，便内有脓血，疑似痢疾。试问如进一步确诊进行微生物学检查时，一般不做哪些检查
A. 血清学鉴定
B. 生化反应
C. 直接涂片革兰染色查形态
D. 免疫荧光菌球试验
E. 检测细菌核酸

正确答案：C。直接涂片革兰染色查形态

解析：痢疾分离培养与鉴定：接种肠道杆菌选择性培养基，37℃孵育18～24小时，挑取无色半透明的可疑菌落，作生化反应和血清学凝集试验，确定菌群和菌型。如遇非典型菌株，须作系统生化反应以确定菌属；必要时，用适量菌液接种于豚鼠结膜上，观察24小时，如有炎症，则为有毒菌株。痢疾快速诊断法：①荧光菌球法：适于检查急性菌痢的粪便标本。②协同凝集试验：用志贺氏菌的lgG抗体与富含A蛋白的葡萄球菌结合，以此为试剂，测定患者粪便滤液中志贺氏菌的可溶性抗原。直接涂片法不应用于志贺菌属的检查中。掌握“志贺氏及沙门氏菌属”知识点。